对新生儿局部使用过多，可能导致中毒的药品是
A. 莫匹罗星
B. 氧化锌
C. 硼酸
D. 炉甘石
E. 甘油

正确答案：C。硼酸

解析：本题考查新生儿用药。对新生儿局部使用过多，可能导致中毒的药品是硼酸（C对）。新生儿的相对体表面积比成人大，而且皮肤角化层薄，皮肤对外部用药吸收快而多。尤其在皮肤黏膜有破损时，局部用药过多可致中毒。治疗皮肤病用的激素类软膏如对新生儿大面积使用，可引起全身性水肿。可引起中毒的外用药物还有硼酸、水杨酸、萘甲唑啉，所以用药时需谨慎小心，以防止药物中毒。